牙周病患者中因牙龈萎缩而在牙颈部以下的部位产生的龋多为
A. 颈部龋
B. 冠部龋
C. 邻面龋
D. 根龋
E. 窝沟龋

正确答案：D。根龋

解析：根龋：根龋，也称根面龋。多见于中老年人和牙周病患者。龋损部位多围绕牙颈部，可有龋洞，也常见牙根表面广泛的浅表损害。掌握“龋病的临床表现与分类”知识点。